环孢素常见的不良反应是
A. 肾脏毒性
B. 服药后2小时
C. 心脏毒性
D. 服药后8小时
E. 早晨服药前

正确答案：A。肾脏毒性

解析：本题考查环孢素的不良反应。环孢素不良反应发生率较高，其中最常见的不良反应是肾毒性，其次可见肝损害（A对）、嗜睡、多毛症等。